对确诊结核的最有价值的检查是
A. 血清结核杆菌抗体
B. γ-干扰素释放实验
C. 痰结核杆菌PCR
D. 痰结核杆菌培养
E. PPD试验

正确答案：D。痰结核杆菌培养

解析：诊断肺结核的金标准是痰培养（D对），其结果准确可靠，灵敏度高，并且也可以测定药物敏感性和菌种鉴定。血清结核菌抗体（A错）、γ-干扰素释放实验（B错）、痰结核菌PCR（C错）这些方法多在研究阶段，且还需改进和完善。PPD（E错），即结核菌素皮肤试验，广泛应用于检出结核分枝杆菌的感染，而非检出结核病，仅对儿童、少年和青年的结核病诊断有参考意义，且在卡介苗普遍接种的地区，结核菌素试验使结核分枝杆菌感染的检出受到很大限制。